男，5岁。尿少2天，晨起眼睑水肿，下肢凹陷性浮肿，查尿蛋白（+++），红细胞0～3个/HP，BP100/70mmHg，首先考虑的诊断是
A. 肾炎性肾病
B. 单纯性肾病
C. 急进性肾炎
D. 急性肾炎
E. 慢性肾炎

正确答案：B。单纯性肾病

解析：患儿急性起病，出现水肿少尿但并未出现镜下血尿，血压不高，未出现肾衰表现。患儿尿蛋白（＋＋＋）且伴有水肿，首先应考虑肾病综合征。而肾病综合征分为单纯型和肾炎型，单纯型表现为典型对“三多一少”，肾炎型除“三多一少”之外还有其他症状，如镜下血尿、持续性高血压、肾功能不全、低补体血症等，本例中未提及相关症状，因此可诊断为单纯性肾病（B对）。